假定某人群的平均期望寿命为70岁，其中：健康生活60岁；非卧床活动受限（生命质量权重值为0.6）5年；卧床功能丧失（生命质量权重值为0.4）5年；那么该人群的质量调整生存年是
A. 64岁
B. 65岁
C. 66岁
D. 67岁
E. 68岁

正确答案：B。65岁